与体表化脓感染相关的肝脓肿的常见致病菌是
A. 大肠埃希菌
B. 双歧杆菌
C. 金黄色葡萄球菌
D. 铜绿假单胞菌
E. 艰难梭状芽胞杆菌

正确答案：C。金黄色葡萄球菌

解析：细菌性肝脓肿的致病菌多为大肠埃希菌、金黄色葡萄球菌、厌氧链球菌、类杆菌属等。而体表化脓感染（疖、痈等）的致病菌多为金黄色葡萄球菌。体表化脓并发菌血症时，金黄色葡萄球菌可经肝动脉入肝引起细菌性肝脓肿。综合考虑，与体表化脓感染相关的肝脓肿的常见致病菌是金黄色葡萄球菌（C对）。胆源性肝脓肿多为胆道逆行感染所致，即肠道内的大肠埃希菌（A错）经十二指肠大乳头，沿胆道上行，经胆总管逆行进入肝脏，引起细菌性肝脓肿。双歧杆菌（B错）、铜绿假单胞菌（D错）、艰难梭状芽胞杆菌（E错）不是细菌性肝脓肿的常见致病菌。